男性，52岁。渐起右上下肢抖动1年半，既往史无特殊。检查：血压150/95mmHg，神志清楚，表情呆板，右上下肢肌力正常，肌张力增高，呈齿轮样，在上下肢可见静止性震颤，余神经系统检查未发现异常。最可能的诊断是
A. 脑血栓形成
B. 震颤麻痹
C. 肝豆状核变性
D. 癫痫局限性运动性发作
E. 小舞蹈病

正确答案：B。震颤麻痹